疮疡溃后,不宜使用的外用药是
A. 膏药
B. 油膏
C. 箍围药
D. 酊剂
E. 腐蚀剂

正确答案：D。酊剂

解析：膏药适应症 一切外科疾病初起、成脓、溃后各个阶段，均可应用（A错）。油膏适应症 适用于肿疡、溃疡，皮肤病糜烂结痂渗液不多者，以及肛门病等（B错）。箍围药适应症 凡外疡不论初起、成脓及溃后，肿势散漫不聚而无集中之硬块者，均可使用（C错）。酊剂 一般用于疮疡未溃及皮肤病等。一般酊剂有刺激性，所以凡疮疡破溃后或皮肤病有糜烂者均应禁用（D对）。腐蚀药 凡肿疡在脓未溃时；痔疮、瘰疬、赘疣、息肉等病；溃疡破溃以后，疮口太小，引流不畅；疮口僵硬，胬肉突出，腐肉不脱等妨碍收口时均可使用（E错）。